传染病病人能排出病原体的整个时间称为
A. 潜伏期
B. 前驱期
C. 传染期
D. 极期
E. 恢复期

正确答案：C。传染期